关于根尖1/3根折，不正确的描述是
A. 是最常见的根折类型
B. 6～8周后牙髓活力可能恢复
C. 活力尚存的患牙应定期复查
D. 需做预防性牙髓治疗
E. 复诊牙髓坏死时做根管治疗术

正确答案：D。需做预防性牙髓治疗

解析：本题考查根折。关于根尖1/3根折，不正确的描述是需做预防性牙髓治疗（D错，为本题的正确答案）。1.根折的类型：根折按其部位可分为颈侧1/3、根中1/3和根尖1/3，最常见者为根尖1/3（A对）。2.根折的治疗：（1）一些患者就诊时，牙髓活力测验无反应，但6～8周后可出现反应（B对）。据推测，无活力反应是牙髓在外伤时血管和神经受损伤所引起的“休克”所致，随其“休克”的逐渐恢复而再出现活力反应。（2）凡仍有活力的牙髓，应在治疗后1、3、6个月及以后几年中，每半年复查1次，以判明牙髓的活力状况（C对）。牙的永久性修复都应在受伤后6～8周进行。（3）对根尖1/3折断，在许多情况下只行夹板固定，无需牙髓治疗，有可能出现修复并维持牙髓活力，那种认为根折牙应进行预防性牙髓治疗的观点是不正确的。因为根折后立即进行根管治疗常有可能把根管糊剂压入断端之间，反而影响其修复。（4）当牙髓有坏死时，则应迅速进行根管治疗术（E对）。